肝胃韧带和胃前方即为
A. 左肝上前间隙
B. 左肝下前间隙
C. 左肝上后间隙
D. 左肝下后间隙
E. 右肝上间隙

正确答案：B。左肝下前间隙

解析：肝周间隙分为肝上间隙和肝下间隙，将肝与膈之间的腹膜腔间隙称为肝上间隙，而于肝脏面与横结肠之间的间隙称为肝下间隙。借镰状韧带分别将肝上间隙和肝下间隙分为左肝上间隙、左肝下间隙、右肝上间隙及右肝下间隙。其中左肝下间隙借小网膜分为左肝下前间隙和左肝下后间隙（网膜囊）。肝胃韧带和胃前方位于肝脏面及小网膜前方，即左肝下前间隙（B对）。